下列按照假药论处的是
A. 超过有效期的药品
B. 所注明的适应证超出规定范围的药品
C. 更改有效期的药品
D. 药品成分的含量不符合国家药品标准的药品
E. 未注明有效期的药品

正确答案：B。所注明的适应证超出规定范围的药品

解析：《药品管理法》规定，所注明的适应症超出规定范围的药品按假药论处（B对）。劣药，是指药品成分含量不符合国家药品标准的药品（D错）。标准规定的成分不符，以及以非药品冒充药品或者以他种药品冒充此种药品的。《药品管理法》规定，更改有效期或者未标明有效期的药品（CE错）；超过有效期的药品（A错）按劣药论处（P184-P185）。